患者，女，18岁。面色萎黄，形体消瘦，腹部隐痛，大便时有虫节片排出，诊断为绦虫病。单用槟榔驱虫，其用量是
A. 0.06～0.1g
B. 0.3～0.9g
C. 1～3g
D. 10～15g
E. 30～60g

正确答案：E。30～60g

解析：槟榔对绛虫、蛔虫、蜕虫、钩虫、姜片虫等肠道寄生虫都有驱杀作用，并以泻下作用驱除虫体为其优点。用治绛虫证疗效最佳，可单用，驱绛虫、姜片虫30～60g（E对）。